药物经济学研究的初级服务对象包括
A. 卫生管理人员
B. 患病者本人
C. 患者权利组织
D. 医疗保险公司
E. 临床医务人员

正确答案：A、B、D、E。卫生管理人员；患病者本人；医疗保险公司；临床医务人员